治阳明腑实证常与大黄配伍的药物是
A. 番泻叶
B. 甘遂
C. 芒硝
D. 火麻仁
E. 生地黄

正确答案：C。芒硝

解析：大黄常与芒硝、厚朴、枳实等配伍，以增强泻下攻积之力，用治阳明腑实证，如大承气汤（C对）。番泻叶的功效为泻热行滞，通便；大黄的功效为泻下攻积，清热泻火，凉血解毒。不建议两者同时服用，泻下力过强（A错）。甘遂若与大黄、阿胶配伍，可用治妇人少腹满如敦状，小便微难而不渴，如大黄甘遂汤（《金匮要略》）（B错）。若大黄用量较轻，则泻下力缓和，与麻仁、杏仁、蜂蜜等润肠药同用，方如麻子仁丸（《伤寒论》）（D错）。如配麦冬、生地、玄参等，可治热结津伤者，方如增液承气汤（《温病条辨》）（E错）。